患者，男，60岁。入院诊断为：高胆固醇血症、支原体肺炎。医师拟选用克拉霉素治疗支原体肺炎，同时需进行调血脂治疗，不宜与克拉霉素合用的调血脂药是
A. 依折麦布
B. 非诺贝特
C. 辛伐他汀
D. 氟伐他汀
E. 瑞舒伐他汀

正确答案：C。辛伐他汀

解析：本题考查药物相互作用。不宜与克拉霉素合用的调血脂药是辛伐他汀（C对）。辛伐他汀经过CYP3A4酶代谢，而克拉霉素为肝药酶抑制剂，不能与经过CYP3A4酶代谢药物合用，会增加药物不良反应，故不宜与克拉霉素合用的调血脂药是辛伐他汀。依折麦布（A错）无诱导细胞色素P450药物代谢酶的作用。非诺贝特（B错）不是细胞色素（CYP）P450亚型CYP3A4、CYP2D6、CYP2E1、或CYPA2的抑制剂，但在治疗浓度下，它们是CYP2C19和CYP2A6的弱抑制剂，是CYP2C9的弱至中度抑制剂。氟伐他汀（D错）经过CYP2C9酶代谢。瑞舒伐他汀（E错）经过CYP2C9/CYP2C19代谢。